下列哪一项论述是正确的
A. 血胆固醇值增高，动脉粥样硬化的发病危险增高
B. 血胆固醇值增高，动脉粥样硬化的发病危险降低
C. 血胆固醇值降低，动脉粥样硬化的发病危险增高
D. 血胆固醇值增高或降低，动脉粥样硬化的发病危险不变
E. 以上均不对

正确答案：A。血胆固醇值增高，动脉粥样硬化的发病危险增高